下列何器官不属于男性内生殖器
A. 睾丸
B. 附睾
C. 尿道海绵体
D. 精囊腺
E. 无

正确答案：C。尿道海绵体

解析：睾丸（A对）、附睾（B对）、精囊腺（D对）均为男性内生殖器的组成部分。尿道海绵体（C错，为本题正确答案）为男性外生殖器阴茎的组成部分。